可确诊霍乱的实验室检查是
A. 粪便检查
B. 胆汁培养
C. 血培养
D. 肥大反应
E. 粪便培养

正确答案：E。粪便培养

解析：霍乱是由霍乱弧菌所致的烈性肠道传染病，发病急、传播快，在我国属于甲类传染病。临床上以剧烈无痛性泻吐、米泔水样大便、严重脱水、肌肉痛性痉挛及周围循环衰竭等为特征。在新采集到水样大便悬滴中，暗视野下霍乱弧菌显现出流星状或鱼群状活泼穿梭运动，这是霍乱弧菌动力试验阳性，当加入一滴霍乱弧菌多价诊断血清，运动马上停止，弧菌并发生凝集，这就是霍乱弧菌制动试验阳性，简单快捷，是常用的实验室检查手段（E对）。